A型行为性格与下列哪项疾病有关
A. 溃疡病
B. 风心病
C. 冠心病
D. 癌症
E. 神经症

正确答案：C。冠心病